在气雾剂中不需要使用的附加剂是
A. 抛射剂
B. 遮光剂
C. 抗氧剂
D. 润湿剂
E. 潜溶剂

正确答案：B。遮光剂

解析：本题考查气雾剂的附加剂。遮光剂（B错，为本题正确答案）常用于固体制剂，气雾剂中不需要使用；气雾剂中常用抛射剂（A对）、润湿剂（D对）、潜溶剂（E对）；易氧化的药物可加入抗氧剂（C对）。